在机体抗感染中发挥主要作用的是
A. SIgA
B. IgG
C. IgE
D. IgM
E. IgD

正确答案：B。IgG